进行暴发调查时的首要工作是
A. 计算各种罹患率
B. 形成病因假设并检验假设
C. 核实诊断
D. 扑灭疫情
E. 制定防治措施

正确答案：C。核实诊断